能体现人体实验科学原则的是
A. 以健康人或病人作为人体实验的受试对象
B. 人体试验时都需要使用对照和双盲法
C. 人体实验都需要伦理委员会审查
D. 参与人体实验的受试者只有得到专家的允许后，中途才可以退出实验
E. 脆弱人群若参加人体实验，需要监护人的签字同意

正确答案：B。人体试验时都需要使用对照和双盲法

解析：人体实验的基本伦理准则：①人体实验必须合理保护受试者利益②人体实验必须经过受试者知情同意③人体实验必须恪守严谨的学风，实验的全过程都严格遵循医学科学原理，人体实验时都需要使用实验对照和双盲法（B对），体现了人体实验科学原则。缺乏或丧失知情同意能力的弱势人群若参加实验，需要监护人的签字（E错），体现人体实验知情同意的伦理原则。